雌激素水平低下的最常见症状是
A. 阴道干涩
B. 潮热
C. 情绪低落
D. 失眠
E. 月经稀少

正确答案：B。潮热

解析：雌激素水平低下的最常见症状是潮热（B对），为雌激素降低，血管舒缩功能不稳定所致。阴道干涩（P365）（A错）是泌尿生殖道萎缩的远期症状。情绪低落（P365）（C错）是围绝经期妇女的精神神经症状；失眠（P365）（D错）是绝经综合征中的自主神经失调症状；月经稀少（P365）（E错）是绝经过渡期的常见症状。以上四项均不是雌激素水平低下的最常见症状。